女，30岁。转移性右下腹痛5天，加重伴畏寒、发热2天。查体：全腹肌紧张，有明显压痛和反跳痛，麦氏点压痛明显，肠鸣音消失。腹腔穿刺抽出脓性液体，细菌培养结果最有可能是
A. 粪链球菌
B. 铜绿假单胞菌
C. 变形杆菌
D. 金黄色葡萄球菌
E. 大肠埃希菌

正确答案：E。大肠埃希菌

解析：青年女性患者，转移性右下腹痛，并伴畏寒、发热，查体可见全腹肌紧张、压痛、反跳痛（腹膜刺激征），麦氏点压痛明显，肠鸣音消失（提示急性阑尾炎），腹腔穿刺抽出脓性液体（提示急性阑尾炎穿孔），结合患者病史、体查和腹腔穿刺检查，应诊断为急性阑尾炎穿孔。阑尾穿孔后，肠道内常驻菌群进入腹腔可导致继发性腹膜炎。由于胃肠道内的常驻菌群以大肠杆菌最常见，故腹腔穿刺抽出脓性液体的细菌培养结果最有可能是大肠埃希菌（E对），而粪链球菌（A错）和变形杆菌（C错）相对较少见。铜绿假单胞菌（B错）、金黄色葡萄球菌（D错）不是肠道内的常驻菌，因此腹腔穿刺液培养不会出现上述两种细菌。